肠道病毒一般不引起的疾病是
A. 尿道炎
B. 手足口病
C. 脊髓灰质炎
D. 疱疹性咽峡炎
E. 心肌炎

正确答案：A。尿道炎

解析：肠道病毒是指经消化道感染和传播，能在肠道中复制并引起人类相关疾病的胃肠道感染病毒，虽然是经消化道感染，但引起的主要疾病却在肠道外，所以记住其肠道外表现很重要。肠道病毒主要包括脊髓灰质炎病毒（C错），柯萨奇病毒，埃可（ECHO）病毒，新型肠道病毒。其中柯萨奇病毒可以引起手足口病（B错），心肌炎（E错）和疱疹性咽峡炎（D错），肠道病毒一般不引起尿道炎（A对）。